头晕耳鸣，视物旋转，闭目可缓解，恶心呕吐；舌苔白腻，脉濡，其临床意义是
A. 阴虚阳亢
B. 痰湿中阻
C. 心脾两虚
D. 风火上扰
E. 肾精不足

正确答案：B。痰湿中阻

解析：本题考查的是眩晕的辨证论治。头晕耳鸣，视物旋转，闭目可缓解，恶心呕吐；舌苔白腻，脉濡，其临床意义是痰湿中阻（B对）。眩晕痰湿中阻证：【症状】眩晕，头重昏蒙，或伴视物旋转，胸闷恶心，呕吐痰涎，食少多寐。舌苔白腻，脉濡。